25岁男性患者，于8月份突然发病，表现为发冷、寒战、高热、大汗而后缓解，隔日发作一次已两周，血涂片查到疟原虫。经氯喹抗疟治疗后症状迅速缓解，为防止复发，应采用的药物是
A. 奎宁
B. 乙胺嘧啶
C. 甲氟喹
D. 青蒿素
E. 伯氨喹啉

正确答案：E。伯氨喹啉

解析：8月患病，发冷寒战高热大汗而后缓解，隔日发作，血涂片查到疟原虫，应用氯喹治疗有效，应诊断为间日疟，为防止复发应采用的药物是伯氨喹（E对）。奎宁（P286）（A错）用于耐氯喹疟原虫株感染患者。乙胺嘧啶（P285）（B错）主要用于联合治疗。甲氟喹（P286）（C错）为无青蒿琥酯国家耐氯喹疟疾的首选药物。青蒿素及其衍生物（P286）（D错）为我国耐药疟原虫感染者首选抗疟药。